患儿，5岁，舌苔花剥，状如地图，经久不愈，其病机是
A. 脾之气阳不足
B. 肺之气阴亏虚
C. 乳食积滞不化
D. 胃之气阴不足
E. 脾之运化失健

正确答案：D。胃之气阴不足

解析：舌与内脏关系密切，舌为心之首，又为脾胃之外候，脾的经络从胃上行至咽部，系于舌体，而舌苦的形成，又属胃气熏蒸所生。若素体虚弱，先后天不足，脾气虚亏，胃之气阴不足（D对）舌苔生成有碍，形成花剥苔、状如地图。乳食积滞不化的舌苔表现为霉酱苔（C错）。脾之运化失健的舌象变化可表现为舌短缩而胖，苔滑腻（E错）。